归脾汤的功效为
A. 健脾益气,宁心安神
B. 益气补血,健脾宁心
C. 健脾养心,益气摄血
D. 滋阴清热,补心安神
E. 健脾升阳,渗湿止泻

正确答案：B。益气补血,健脾宁心

解析：归脾汤的功效为益气补血,健脾宁心。主治心脾气血两虚证和脾不统血证，因思虑过多，劳伤心脾，气血两虚所致，为治疗心脾气血两虚的常用方（B对）。